属于糖尿病患者典型症状的是
A. 体重增加
B. 多尿
C. 少尿
D. 饮食减少
E. 眩晕

正确答案：B。多尿

解析：本题考查糖尿病患者典型症状。糖尿病病人的典型临床表现为“三多一少”，即多饮、多食、多尿（B对ACDE错）、消瘦等。